判断疾病预后，最常用的研究方法是
A. 临床经验
B. 疾病自然史
C. 前瞻性观察
D. 回顾对比
E. 临床试验

正确答案：E。临床试验

解析：本题考查临床试验的作用。临床试验（E对ABCD错）常用于判断疾病的预后效果。